患儿，4岁。发热2天，纳差恶心，呕吐腹泻，口腔内可见数个疱疹，手、足掌心部出现米粒大小的斑丘疹、疱疹，疱液清亮，躯干处未见有皮疹。舌质红，苔薄黄腻，脉浮数。其证候是
A. 邪伤肺卫
B. 邪犯肺脾
C. 邪炽气营
D. 湿热熏蒸
E. 湿盛阴伤

正确答案：B。邪犯肺脾

解析：题中患儿口腔内可见数个疱疹，手、足掌心部出现米粒大小的斑丘疹、疱疹，为手足口病的典型表现，故诊断为手足口病。患儿除手足肌肤、口腔部疱疹外，全身症状不明显，为邪犯肺脾的特征，加之纳差恶心，呕吐腹泻，舌质红，苔薄黄腻，脉浮数，辨为手足口病邪犯肺脾证。（B对）。邪犯肺卫证无纳差恶心，呕吐腹泻的症状（A错）。邪炽气营多有壮热，口腔疼痛难忍，小便赤，大便干结的症状（C错）。湿热熏蒸多有身热持续，烦躁口渴，小便黄赤，大便秘结，疱疹痛痒剧烈（D错）。题中无阴津损伤的表现（E错）。